某女，40岁。体硕肥胖，瘀热痰湿内生，导致脾胃气郁，症见胸脘痞胀满，饮食滞停。治当理气解郁、宽中除满，宜选用的成药是
A. 越鞠丸
B. 左金丸
C. 胃苏颗粒
D. 健脾消食丸
E. 木香顺气颗粒

正确答案：A。越鞠丸

解析：本题考查的是越鞠丸的功能与主治。体硕肥胖，瘀热痰湿内生，导致脾胃气郁，症见胸脘痞胀满，饮食滞停。治当理气解郁、宽中除满，宜选用的成药是越鞠丸（A对）。越鞠丸：【功能】理气解郁，宽中除满。【主治】瘀热痰湿内生所致的脾胃气郁，症见胸脘痞闷、腹中胀满、饮食停滞、嗳气吞酸。左金丸（B错）：【功能】泻火，疏肝，和胃，止痛。【主治】肝火犯胃，脘胁疼痛，口苦嘈杂，呕吐酸水，不喜热饮。胃苏颗粒（C错）：【功能】理气消胀，和胃止痛。【主治】气滞型胃脘痛，症见胃脘胀痛、窜及两胁、得嗳气或矢气则舒、情绪郁怒则加重、胸闷食少、排便不畅、舌苔薄白、脉弦；慢性胃炎及消化性溃疡见上述证候者。健脾消食丸（D错）：【功能】健脾，和胃，消食，化滞。【主治】脾胃气虚所致的疳证，症见小儿乳食停滞、脘腹胀满、食欲不振、面黄肌瘦、大便不调。木香顺气颗粒（E错）：【功能】行气化湿，健脾和胃。【主治】湿阻中焦、脾胃不和所致的湿滞脾胃证，症见胸膈痞闷、脘腹胀痛、呕吐恶心、嗳气纳呆。